根据《药品管理法》，药品经营企业零售药品未正确说明用法、用量等事项时，应承担的行政法律责任为
A. 责令改正，给予警告
B. 责令停业整顿
C. 处十万元以上五十万元以下的罚款
D. 责令暂停销售

正确答案：A。责令改正，给予警告

解析：本题考查违反药品经营管理要求的法律责任。根据《药品管理法》，药品经营企业零售药品未正确说明用法、用量等事项时，应承担的行政法律责任为责令改正，给予警告（A对）。违反药品经营管理要求的法律责任：（一）经营企业购销药品未按照规定记录，零售企业未依法开展药学服务的法律责任：根据《药品管理法》第一百三十条规定，药品经营企业购销药品未按照规定进行记录，零售药品未正确说明用法、用量等事项，或者未按照规定调配处方的，责令改正，给予警告；情节严重的，吊销药品经营许可证。（二）药品网络交易第三方平台未依法履行管理义务的法律责任：根据《药品管理法》第131条的规定，药品网络交易第三方平台提供者未履行资质审核、报告、停止提供网络交易平台服务等义务的，责令改正，没收违法所得，并处二十万元以上二百万元以下的罚款；情节严重的，责令停业整顿（B错），并处二百万元以上五百万元以下的罚款。未制定上市后风险管理计划的法律责任：根据《药品管理法》第127条第一款第6项的规定，有未制定药品上市后风险管理计划行为的，责令限期改正，给予警告；逾期不改正的，处十万元以上五十万元以下的罚款（C错）。